可用于中药炮制的液体辅料有
A. 甘草汁
B. 山羊血
C. 黑豆汁
D. 吴茱萸汁
E. 石灰水

正确答案：A、B、C、D、E。甘草汁；山羊血；黑豆汁；吴茱萸汁；石灰水

解析：本题考查的是液体辅料的种类。可用于中药炮制的液体辅料有甘草汁（A对）、山羊血（B对）、黑豆汁（C对）、吴茱萸汁（D对）与石灰水（E对）。中药炮制常用的液体辅料有酒、醋、盐水、姜汁、蜜、油等。中药炮制中还有用到其他液体辅料的，主要有吴茱萸汁、白萝卜汁、羊脂油、鳖血、山羊血、石灰水、甘草汁、黑豆汁及其他药汁等。